开展药品不良反应报告与监测的目的的意义有
A. 减少ADR的危害
B. 促进新药的研制开发
C. 为医疗事故鉴定和诉讼提供证据
D. 促进临床合理用药
E. 弥补上市前研究的不足

正确答案：A、B、D、E。减少ADR的危害；促进新药的研制开发；促进临床合理用药；弥补上市前研究的不足

解析：本题考查监测药品不良反应的意义。开展药品不良反应报告与监测的意义包括：1.弥补药品上市前研究的不足（E对）；2.减少ADR的危害（A对）；3.促进新药的研制开发（B对）；4.促进临床合理用药（D对）。开展药品不良反应报告与监测不能为医疗事故鉴定和诉讼提供证据（C错）。